男性，23岁，学生，1周前因淋雨后感冒，自服康泰克后好转。3天前开始出现寒战、发热，伴右胸痛、右上腹痛而到校医务室就诊。查体：T39℃，全身皮肤无黄染，右下肺呼吸音减弱，未闻及干湿哕音，右上腹叩击痛（+），肝脾未触及，双肾区叩击痛（-）。WBC15×109/L，尿蛋白（+），尿沉渣涂片（-）。假设上述诊断成立，首选的治疗药物是
A. 左氧氟沙星
B. 头孢曲松
C. 万古霉素
D. 阿米卡星
E. 青霉素

正确答案：E。青霉素

解析：结合上述临床表现，初步考虑诊断为肺炎链球菌肺炎，而肺炎链球菌肺炎最敏感的药物仍为青霉素，只有对青霉素过敏、耐青霉素或多重耐药菌株感染者，方考虑使用喹诺酮类、头孢噻肟或头孢曲松等药物，而多重耐药菌株感染者才使用万古霉素、替考拉宁等。掌握“肺炎”知识点。